某男，42岁。自诉咽中如有物阻，呕吐不出，吞咽不下，胸胁满闷，化痰降硬，处以半夏厚朴；其药物构成为姜半夏、茯苓、厚朴、生姜、紫苏叶。处方中姜半夏长于
A. 清痰行水，降气止呕
B. 燥湿清痰，下气除满
C. 温肺祛痰，利气散结
D. 温中化痰，降逆止呕
E. 清化热痰，降燥止呕

正确答案：D。温中化痰，降逆止呕

解析：本题考查的是姜半夏的主要作用。处方中姜半夏长于温中化痰、降逆止呕（D对）。半夏：【炮制作用】半夏味辛，性温；有毒。归脾、胃、肺经。具有化痰止咳、消肿散结的功能。①生半夏有毒，使人呕吐，咽喉肿痛，失音，一般不做内服，多做外用，用于疮痈肿毒，湿痰咳嗽。②半夏经炮制后，能降低毒性，缓和药性，消除副作用。③清半夏长于化痰，以燥湿化痰为主，用于湿痰咳嗽，痰热内结，风痰吐逆，痰涎凝聚，咯吐不出。④姜半夏增强了降逆止呕作用，以温中化痰、降逆止呕为主，用于痰饮呕吐，胃脘痞满。⑤法半夏偏于祛寒痰，同时具有调和脾胃的作用，多用于痰多咳嗽，痰饮眩悸。亦多用于中药成方制剂中。